AMP和GMP在细胞内分解时，最终均生成
A. 黄嘌呤
B. 尿酸
C. 次黄嘌呤核苷酸
D. 黄嘌呤核苷酸
E. 黄嘌呤核苷

正确答案：B。尿酸

解析：AMP生成次黄嘌呤（IMP），后者在黄嘌呤氧化酶作用下氧化成黄嘌呤，最后生成尿酸。GMP生成鸟嘌呤，后者转变成黄嘌呤，最后也生成尿酸。掌握“核苷酸代谢及调节”知识点。